下列哪一项与细胞内钙超载发生无关？
A. 细胞膜外板与糖被膜分离
B. Na+-Ca2+交换加强
C. 线粒体通透性转运孔关闭
D. 钙泵功能障碍
E. 线粒体功能障碍

正确答案：C。线粒体通透性转运孔关闭

解析：细胞膜外板与糖被膜分离（B对）出现在再灌注时发生钙超载时，缺血－再灌细胞膜损伤引起钙超载的机制是：心细胞膜正常结构被破坏，对Ca2+通透性增强，Na+-Ca2+交换加强（B对）；①再灌注时生成大量的自由基，使细胞膜的脂质过氧化，加重膜结构的破坏；②细胞内Ca2+增加激活磷脂酶，使膜磷脂降解，进一步增加细胞膜对Ca2+的通透性，共同促使胞质Ca2+浓度升高。(2)线粒体功能障碍（E对）(3)内质网膜损伤：内质网钙摄取是依赖水解ATP的主动转运过程。自由基的作用及膜磷脂的降解可造成内质网膜损伤，使其钙泵功能障碍（D对），对Ca2+摄取减少，引起胞质Ca2+浓度升高。线粒体通透性转运孔关闭（C错，为本题正确答案）与细胞内钙超载发生无关。